对先天性甲状腺功能减退症，新生儿筛查测定的项目是
A. 血清碘
B. T₃，T₄
C. TSH
D. 游离T₃，游离T₄
E. 游离T₃，游离T₄，TSH

正确答案：C。TSH

解析：出生后2～3天的新生儿干血滴纸片检测TSH浓度（C对）浓度是先天性甲状腺功能减退症的新生儿筛查测定项目。血清T4、TSH浓度的测定结果（如T4降低、TSH明显升高），即可确诊小儿先天性甲状腺功能减退症。而血清T3浓度可降低也可正常，可见血清T3、T4、TSH（BDE错）检测是对疑似先天性甲状腺功能减退症患儿和筛查TSH阳性患儿的确诊项目并非筛查项目。血清碘检测临床上少见，不是先天性甲状腺功能减退症新生儿筛查的项目。